在细胞膜载体的帮助下，由膜的高浓度一侧向低浓度一侧转运，不消耗能量的药物转运方式是
A. 主动转运
B. 简单扩散
C. 易化扩散
D. 膜动转运
E. 滤过

正确答案：C。易化扩散

解析：本题考查药物的转运方式。易化扩散（C对）是借助细胞膜载体，由膜的高浓度一侧向低浓度一侧转运的过程，不需要消耗能量；主动转运（A错）逆浓度梯度的转运；简单扩散（B错）是顺浓度梯度的被动运输；膜动转运（D错）是细胞膜通过主动变形，膜凹陷吞没液滴或微粒，将某些物质摄入细胞内或从细胞内释放到细胞外的过程；滤过（E错）是指水溶性小分子物质依靠膜两侧的流体静压或渗透压通过孔道的过程。